导致根尖周炎的主要途径是
A. 牙髓感染
B. 牙周途径
C. 血源感染
D. 邻牙根尖周病
E. 以上均不是

正确答案：A。牙髓感染

解析：感染途径：大多数由牙髓途径造成根尖周组织的感染；少数经由牙周病变、邻牙根尖周病变或血源感染。掌握“根尖周病概述”知识点。